引起脑萎缩的最常见原因是
A. 脑水肿
B. 脑外伤
C. 脑动脉粥样硬化
D. 脑脓肿
E. 脑结核

正确答案：C。脑动脉粥样硬化

解析：脑萎缩是由多种原因引起的脑组织体积缩小的一种精神衰退性疾病，在临床最主要的症状是痴呆，尤其是老年人易引起老年痴呆症。多由遗传、脑外伤、脑梗塞、脑炎、脑缺血、缺氧、脑动脉硬化、煤气中毒、酒精中毒等引起脑实质破坏和神经细胞的萎缩、变形、消失，其中最主要的致病因素是脑动脉粥样硬化（C对）引起的脑血管长期慢性缺血。